随着颌骨的长大、替牙过程出现的调整空间和恒牙弓的增大的是
A. 上唇系带位置过低
B. 中切牙间间隙
C. 暂时性远中（牙合）
D. 暂时性前牙拥挤
E. 暂时性深覆（牙合）

正确答案：D。暂时性前牙拥挤

解析：暂时性前牙拥挤：恒切牙初萌时，可能显示拥挤状态。随着颌骨的长大、替牙过程出现的调整空间和恒牙弓的增大，恒牙调整位置，恒牙列逐渐排齐，牙弓规则。若在颌骨发育完全之后，牙列仍是拥挤的，即属异常。掌握“（牙合）的生长发育”知识点。